面部的主要感觉神经是
A. 面神经
B. 三叉神经
C. 耳颞神经
D. 舌神经
E. 舌下神经

正确答案：B。三叉神经

解析：本题考查面部的主要感觉神经。三叉神经是面部的主要感觉神经（B对），其一般躯体感觉纤维分布于额、顶、面部皮肤，眼球和眶内结构，口、鼻腔及舌前2/3黏膜，牙及牙龈，泪腺、腭及鼻腔黏膜的腺体。面神经为以运动神经为主的混合性神经（A错），其感觉纤维主要传导外耳道、外耳门周围及小部分耳后皮肤的痛、温、触觉冲动。耳颞神经为感觉神经，属于三叉神经的分支（C错），传递面部部分皮肤的感觉。舌神经为感觉神经，主要分布于下颌舌侧牙龈、口底及舌前2/3的黏膜、舌下腺和下颌下腺（D错）。舌下神经属运动神经（E错）。